在体内可与含羟基或羧基的毒物结合，形成低毒或无毒结合物排出体外，起到解毒和保护肝脏的作用，用于急、慢性肝炎治疗的药物是
A. 硫普罗宁
B. 腺苷蛋氨酸
C. 葡醛内酯
D. 异甘草酸镁
E. 门冬氨酸钾镁

正确答案：C。葡醛内酯

解析：本题考查肝炎治疗药物。葡醛内酯（C对）在体内可与含有羟基或羧基的毒物结合，形成低毒或无毒结合物排出体外，保护肝脏和解毒，用于急慢性肝炎的辅助治疗；硫普罗宁（A错）有解毒、抗组胺和清除自由基和保护肝细胞作用；腺苷蛋氨酸（B错）为利胆药；异甘草酸镁（D错）临床应用于各型肝炎的治疗；门冬氨酸钾镁（E错）适用于低钾血症、洋地黄中毒引起的心律失常及心肌炎后遗症，充血性心力衰竭、心肌梗塞的辅助治疗。